肺结核的传染源是
A. 排菌肺结核病人的痰
B. 排菌肺结核病人的尿
C. 排菌肺结核病人的粪
D. 排菌肺结核病人的血液
E. 排菌肺结核病人的胸液

正确答案：A。排菌肺结核病人的痰

解析：肺结核的传染源是排菌肺结核病人的痰（A对），排菌的开放性肺结核患者是主要传染源，经正规化疗后，随着痰菌排量减少而传染性降低。肺结核的传染途径主要是呼吸道传染，痰涂片阳性的肺结核病人咳嗽、打喷嚏，大声讲话时喷出带有结核杆菌的飞沫，健康人吸入肺部造成感染。排菌肺结核病人的尿（B错）、粪（C错）、血液（D错）、胸液（E错）均非传染病人的传染源。